下列药品中，易引湿的是
A. 硫酸阿托品
B. 明矾
C. 胃蛋白酶
D. 维生素C
E. 地西泮

正确答案：C。胃蛋白酶

解析：本题考查药品的贮存。易引湿的药物有胃蛋白酶（C对）、甘油等。大多数药品在湿度较高的情况下，可使药品稀释、潮解、变形、发霉等。硫酸阿托品（A错）、明矾（B错）易风化。维生素C（D错）易氧化。地西泮（E错）性质较稳定，只需密封保存即可。